限定3日为一疗程的非处方药是
A. 用于解热的解热镇痛药
B. 用于解痉的胃肠解痉药
C. 用于止咳祛痰的镇咳药
D. 用于胃酸过多的抗酸药
E. 用于止痛的解热镇痛药

正确答案：A。用于解热的解热镇痛药

解析：本题考查考查自我药疗的注意事项。限定3日为一疗程的非处方药是用于解热的解热镇痛药（A对）。按疗程购药既能达到治疗的目的，又可以避免浪费。非处方药的限定疗程是：解热镇痛药-用于解热服用3日，用于镇痛服用5日（E错）；胃肠解痉药（B错）-服用1日；感冒用药、镇咳药（C错）、抗酸与胃粘膜保护药-服用1周，如果症状未缓解或未消失应向医师咨询。